急性出血性坏死型胰腺炎的重要特征是
A. 血淀粉酶明显升高
B. 休克
C. 恶心、呕吐
D. 白细胞计数增高
E. 血糖升高

正确答案：A。血淀粉酶明显升高

解析：急性出血性坏死型胰腺炎是急性胰腺炎的一种，相对较少，胰腺内有灰白色或黄色斑块的脂肪组织坏死，其重要特征为血淀粉酶于起病后2～12小时明显升高（A对），48小时开始下降，持续3～5天。休克（B错）、恶心、呕吐（C错）、白细胞计数增高（D错）及血糖升高（E错）可出现于急性胰腺炎或慢性胰腺炎中，但无特异性。